责令停产停业属于
A. 民事责任
B. 刑事责任
C. 行政处罚
D. 行政处分

正确答案：C。行政处罚

解析：本题考查药品安全法律责任分类。责令停产停业属于行政处罚（C对）。药品安全法律责任分类：根据行为人违反药品法律法规的性质和社会危害程度的不同，可将药品安全法律责任分为刑事责任、民事责任和行政责任。1.刑事责任（B错）：药品安全刑事责任，是指行为人违反药品管理法律法规，侵犯了国家药品管理制度和不特定多数人的健康权利，构成犯罪时，由司法机关依照《刑法》规定，对其依法追究法律责任。刑事责任有以下特点：①刑事责任是基于行为人实施了《刑法》明文规定的犯罪行为而产生的，其确立的依据是行为人实施的行为符合犯罪构成要件。②刑事责任具有鲜明的惩罚性，是对当事人最为严厉的一种制裁手段。③刑事责任实现的方式表现为刑法所规定的各类以限制或者剥夺行为人的自由和生命为主的刑罚。根据《刑法》规定，实现刑事责任的方式是刑罚。刑罚是国家审判机构依照刑法的规定，剥夺犯罪分子某种权益直至生命的一种强制行为，分为主刑和附加刑。主刑包括管制、拘役、有期徒刑、无期徒刑和死刑，它们只能单独适用。附加刑有罚金、剥夺政治权利、没收财产，它们可以附加适用，也可以独立适用。对于犯罪的外国人，还可以独立适用或附加适用驱逐出境。我国《刑法》对违反药品法律、法规的犯罪行为的刑事责任作了明确规定，规定了相关罪名，如生产、销售假药罪，生产、销售劣药罪，非法提供麻醉药品、精神药品罪等。根据《药品管理法》第113条第一款规定，药品监督管理部门发现药品违法行为涉嫌犯罪的，应当及时将案件移送公安机关。根据《药品管理法》第114条规定，违反药品管理法规定，构成犯罪的，依法追究刑事责任。2.民事责任（A错）：药品安全民事责任主要是产品责任，即生产者、销售者因生产、销售缺陷产品致使他人遭受人身伤害、财产损失，而应承担的赔偿损失、消除危险、停止侵害等责任的特殊侵权民事责任。《药品管理法》规定的民事责任主要体现在以下四个方面：一是明确了药品上市许可持有人和药品生产经营企业赔偿责任，药品出现质量问题，药品上市许可持有人和药品生产经营企业要承担民事赔偿责任；二是规定境外药品上市许可持有人在中国境内的代理人与持有人承担连带责任；三是民事赔偿首负责任制；四是对生产假劣药或者明知假劣药仍销售的，受害人还可以要求惩罚性赔偿。根据《侵权责任法》第43条的规定，因产品存在缺陷造成损害的，被侵权人可以向产品的生产者请求赔偿，也可以向产品的销售者请求赔偿。根据《侵权责任法》第59条的规定，因药品缺陷造成患者损害的，患者可以向生产者请求赔偿，也可以向医疗机构请求赔偿。因产品存在缺陷造成损害请求赔偿的诉讼时效期间为两年，自当事人知道或者应当知道其权益受到损害时起计算。3.行政责任：药品安全行政责任包括在药品监督管理行政法律关系中，当行政相对人实施了违反行政法律规范的行为，或不履行行政法律义务时，应依法承担的法律后果。根据我国现行药品法律法规的规定，药品行政责任主要包括行政处罚和行政处分。（1）行政处罚：指药品监督管理部门在职权范围内对违反药品法律法规但尚未构成犯罪的行政相对人所实施的行政制裁。药品领域的行政处罚的种类主要有：警告、罚款、没收非法财物、没收违法所得、责令停产停业、暂扣或吊销有关许可证等，2019 年修订的《药品管理法》增加设定了限制人身自由的行政处罚，对生产销售假药和生产销售劣药情节严重的，伪造变造许可证、骗取许可证等情节恶劣的行为，可以由公安机关对相关责任人处五日至十五日的行政拘留。（2）行政处分（D错）：指由有管辖权的国家机关或企事业单位依据行政隶属关系对违法失职人员给予的一种行政制裁。其种类主要有警告、记过、记大过、降级、撤职、开除六种。